属于严重危害人体健康的指标是
A. 水分
B. 真菌毒素
C. 菌落总数
D. 大肠菌群
E. 挥发性盐基总氮

正确答案：B。真菌毒素

解析：本题考查严重危害人体健康的指标。严重危害人体健康的指标包括致病性微生物与毒素，如沙门氏菌、金黄色葡萄球菌及其产生的毒素、真菌毒素（B对ACDE错）等；有毒有害化学物质，如砷、铅、汞、镉、多环芳烃类化合物等；放射性污染物等。